属于核酸一级结构的描述是
A. 核苷酸在核酸长链上的排列顺序
B. tRNA的三叶草结构
C. DNA双螺旋结构
D. DNA的超螺旋结构
E. DNA的核小体结构

正确答案：A。核苷酸在核酸长链上的排列顺序